对于呈气体状态或易挥发的化学毒物的排泄，下列哪一项描述是正确的
A. 通过主动转运的方式经肺泡壁排出气体
B. 排出的速度与吸收的速度成正比
C. 血液中溶解度低可减缓其排除速度
D. 肺通气量加大可加速其排除速度

正确答案：D。肺通气量加大可加速其排除速度

解析：本题考查呈气体状态或易挥发的化学毒物的排泄。对于呈气体状态或易挥发的化学毒物的排泄，肺通气量加大可加速其排除速度（D对ABC错）。